动机产生的2个条件是
A. 需要和目的
B. 需求和目标
C. 诱因和目的
D. 需要和诱因
E. 意志和目的

正确答案：D。需要和诱因